具有减慢心率和加强心肌收缩力的药物有
A. 洋地黄毒苷
B. 奎尼丁
C. 毒毛花苷K
D. 维拉帕米
E. 普鲁卡因胺

正确答案：A、C。洋地黄毒苷；毒毛花苷K